中龋龋洞在治疗时，垫底材料一般为氢氧化钙糊剂，此种材料主要的作用
A. 刺激生成修复性牙本质
B. 酸蚀牙体组织
C. 强度高
D. 粘结力强
E. 可做充填材料

正确答案：A。刺激生成修复性牙本质

解析：氢氧化钙制剂为钙剂，为强碱性，可以抑菌消炎促使修复性牙本质生成。掌握“龋病的治疗原则与非手术治疗方法”知识点。